青年男性，2天来胸背部疼痛，今出现双下肢无力，伴二便障碍，查脐以下各种感觉障碍，双下肢肌力0级，无病理反射。最可能的诊断是
A. 脊髓出血
B. 脊髓肿瘤
C. 急性脊髓炎
D. 吉兰-巴雷综合征
E. 大脑旁脑膜瘤

正确答案：C。急性脊髓炎

解析：患者青年男性，2天来胸背部疼痛（神经根痛），今出现双下肢无力，伴二便障碍，査脐以下各种感觉障碍，双下肢肌力0级（T10平面以下运动障碍、感觉缺失及膀胱、直肠括约肌功能障碍），无病理反射。根据病史特点可以诊断为急性脊髓炎（C对）。脊髓出血（A错）会有背痛剧烈出现，脊髓受损的截瘫表现在数分钟或数小时内即可出现，脊髓蛛网膜下腔出血有急骤颈背痛和脑膜刺激征，脊髓表面血管破裂出血只有背痛而无脊髓受压症状（P334）。脊髓肿瘤（B错）进展缓慢，多表现为慢性脊髓压迫症。吉兰-巴雷综合征（D错）病变部位在脊神经根及周围神经，因而不会出现脐以下各种感觉障碍，双下肢肌力0级等脊髓节段性损害表现，多表现为肢体对称性迟缓性肌无力及双侧面神经麻痹（P350-351）。大脑旁脑膜瘤（E错）一般无背部神经根痛现象，节段性损害不在脐以下，常有病理反射。